有广谱抗菌作用的抗结核药物是
A. 环丙沙星
B. 利福平
C. 多西环素
D. 磺胺嘧啶
E. 庆大霉素

正确答案：B。利福平